慢性牙周炎轻度附着丧失一般为
A. 1～2mm
B. ＞2mm
C. 2mm
D. 3～4mm
E. 5mm以上

正确答案：A。1～2mm

解析：慢性牙周炎轻度：牙龈有炎症和探诊出血，牙周袋≤4mm，附着丧失1～2mm，X线片显示牙槽骨吸收不超过根长的1/3。可有或无口臭。掌握“慢性牙周炎的病因，表现诊断及预后”知识点。